某因素和某疾病间联系强度的最好测量可借助于
A. 潜伏期
B. 传染期
C. RR
D. 整个人群的发病率
E. 以上都不是

正确答案：C。RR

解析：本题考查疾病关联强度指标。RR（C对ABDE错）是表示关联强度的重要指标，RR说明暴露者发生相应疾病的危险是非暴露者的多少倍，具有病因学的意义。